产生心性水肿最主要的发病机制是
A. 水钠潴留
B. 静脉淤血
C. 血浆胶体渗透压下降
D. 淋巴回流受阻
E. 静脉淤血所致的毛细血管流体静压升高

正确答案：E。静脉淤血所致的毛细血管流体静压升高

解析：心性水肿是指右心衰或全心衰时，右心室输出量减少，舒张期末压增高，体循环血液回流障碍，引起体循环淤血。下肢血液因受重力影响，回流明显受阻，使得下肢静脉淤血，毛细血管流体静压升高（E对），有效滤过压增加，导致组织水肿。